患儿，5岁。近2天来腹痛绵绵，时作时止，痛时喜按，面白少华，神疲乏力，手足不温，食后腹胀，大便偏稀。唇舌较淡，脉沉缓，指纹淡红。治疗应首选
A. 养脏散
B. 香砂平胃散
C. 大承气汤
D. 小建中汤
E. 少腹逐瘀汤

正确答案：D。小建中汤

解析：患儿以腹痛为主症，故诊断为腹痛。中阳虚寒，脾阳不振，气血虚弱，脏腑失于温养，脉络凝滞，故见腹痛绵绵，时作时止，痛时喜按；中阳不足，脏腑虚冷，阳气不布，故见面白少华，神疲乏力，手足不温；脾阳虚弱，运化失常，故食后腹胀，大便偏稀；唇舌较淡，脉沉缓，指纹淡红，为虚寒之征，故其证候为脾胃虚弱证，治以温中理脾，缓急止痛，方选小建中汤合理中丸（D对）。养脏散（A错）其功用为温中散寒，理气止痛，适用于腹痛之腹部中寒证。香砂平胃散（B错）其功用为消食导滞，行气止痛，适用于腹痛之乳食积滞证。大承气汤（C错）其功用为峻下热结，适用于腹痛之胃肠结热证。少腹逐瘀汤（E错）其功用为活血化瘀，行气止痛，适用于腹痛之气滞血瘀证。